食品卫生检查发现某个体户出售的猪肉有肉眼可见白色、绿豆大小半透明的水泡状包囊，包囊一端为乳白色。在40cm²的肌肉切面上检出包囊8个。这是患何种疾病的病畜肉
A. 口蹄疫
B. 猪水疱病
C. 囊虫病
D. 旋毛虫病
E. 布鲁菌病

正确答案：C。囊虫病